尺神经容易受损的部位包括
A. 腕管
B. 上臂中部
C. 肱骨内上髁后方
D. 掌心
E. 前臂内侧

正确答案：C。肱骨内上髁后方

解析：尺神经容易受损的部位包括肱骨内上髁后方（C对）、尺侧腕屈肌起点处、豌豆骨外侧。